患者，男，42岁。胃脘胀痛，攻痛连胁，嗳气频作，并呕逆酸苦，二便如常，舌苔薄白，脉沉弦。治疗应首选
A. 足阳明、足厥阴经穴
B. 足阳明经穴
C. 手、足少阳经穴
D. 任脉、足太阴经穴
E. 足太阳、督脉经穴

正确答案：A。足阳明、足厥阴经穴

解析：本题考查常见的病症的辩证、处方。题中患者胃脘胀痛，攻痛连胁，嗳气频作，可辩证为胃痛，并呕逆酸苦，二便如常，舌苔薄白，脉沉弦，可进一步辩证为胃痛中的肝气犯胃。针刺以取足厥阴、阳明经穴为主可用于治疗胃痛中的肝气犯胃（A对）。针刺足阳明经穴可用于治疗乳癖症（B错）。针刺手、足少阳经穴可用于治疗面瘫（C错）。针刺任脉、足太阴经穴可用于腹痛等病症（D错）。针刺足太阳、督脉经穴可用于治疗腰疼、落枕等病症（E错）。